某些基因从一个位置移动到另一位置称为
A. 特异性重组
B. 同源重组
C. 转座重组
D. 接合重组
E. 转化重组

正确答案：C。转座重组

解析：转座重组即某些基因从一个位置移动到另一位置。掌握“DNA重组与基因工程”知识点。